女，31岁。甲状腺次全切术后6小时，憋气烦躁迅速加重，查体：P110／分，BP120/90mmHg，神志消楚，颈部肿胀，口唇发绀，无声音嘶哑呼吸急促双肺呼吸音粗未闻及啰音，此时应给予的紧急处理措施是
A. 立即面罩高流量吸氧
B. 开放伤口，根据情况行气管切开
C. 立即注射呼吸兴奋剂
D. 保持呼吸通畅
E. 半坐位，充分观察

正确答案：B。开放伤口，根据情况行气管切开

解析：患者青年女性，行甲状腺次全切术后6小时（＜术后48小时），憋气烦躁迅速加重，查体：P110次／分（正常值60～100次/分，提示患者呼吸急促），BP120/90mmHg（正常值90～139/60～89mmHg），神志消楚，颈部肿胀，口唇发绀（术后重度呼吸困难典型临床表现），无声音嘶哑（排除单侧喉返神经损伤），呼吸急促，双肺呼吸音粗未闻及啰音。据患者病史、临床表现、查体易诊断患者为甲状腺次全切术后呼吸困难，应立即行床旁抢救，开放伤口，根据情况行气管切开（B对）。立即面罩高流量吸氧（A错）、保持呼吸畅通（D错）、及半坐位，充分观察（E错）均为有效但非紧急措施。